患者，男，56岁。大便秘结，排出困难，面色无华，头晕目眩，心悸，舌淡，苔白，脉细涩。其诊断是
A. 气虚便秘
B. 血虚便秘
C. 阴虚便秘
D. 冷秘
E. 气秘

正确答案：B。血虚便秘

解析：题中患者以大便秘结，排出困难为主症，故诊断为便秘。血虚津少，不能下润大肠，故大便秘结，排出困难；血虚不能上荣，故面色无华；心失所养则悸；血虚不能滋养于闹，故头晕目眩；舌淡，苔白，脉细涩，均为阴血不足之象。故辩证为血虚秘（B对）。气虚便秘可见大便并不干硬，虽有便意，但排便困难，用力努挣则汗出短气，便后乏力，面白神疲等症，无心悸气短，健忘等症（A错）。阴虚便秘可见大便干结，如羊屎状，形体消瘦，头晕耳鸣，两颧红赤，潮热盗汗等症，无心悸气短，健忘等症（C错）。冷秘可见大便艰涩，腹痛拘急，胀满拒按，胁下偏痛，手足不温等症，无心悸气短，健忘等症（D错）。气秘可见大便干结，或不甚干结，欲便不得出，或便而不爽，肠鸣失气等症，无心悸气短，健忘等症（E错）。